慢性再生障碍性贫血经治疗已缓解，且血红蛋白含量高于多少时可拔牙
A. 12g/dL
B. 11g/dL
C. 10g/dL
D. 9g/dL
E. 8g/dL

正确答案：E。8g/dL

解析：本题考查贫血对牙拔除术的影响及拔牙禁忌证。再生障碍性贫血患者，血液检查时白细胞、血小板、血红蛋白及红细胞均减少，出血时间及凝血时间也延长。如经治疗已缓解且血红蛋白在80g/L（8g/dL）（E对）以上者，可以拔牙。WHO诊断贫血的血红蛋白标准为：成年男性低于130g/L，成年女性为低于120g/L（12g/dL）（A错），孕妇低于110g/L（11g/dL）（B错）；血红蛋白在80g/L以上，血细胞比容在30%以上，一般可以拔牙。